慢性肉芽肿病是属于
A. B细胞缺陷病
B. T细胞缺陷病
C. 联合免疫缺陷病
D. 吞噬细胞缺陷病
E. 补体缺陷病

正确答案：D。吞噬细胞缺陷病

解析：吞噬细胞缺陷导致还原性辅酶Ⅱ氧化酶系统基因缺陷，导致患者出现慢性肉芽肿病，且中性粒细胞不能有效地产生杀菌性超过氧化物，可频发细菌和真菌感染。掌握“免疫缺陷概述及原发性、获得性免疫缺陷病”知识点。